构成牙的主体的是
A. 牙质
B. 釉质
C. 牙骨质
D. 牙髓
E. 牙龈

正确答案：A。牙质

解析：构成牙的主体为牙质(A对)。